正常足月新生儿出生时身长约
A. 40cm
B. 50cm
C. 60cm
D. 65cm
E. 70cm

正确答案：B。50cm

解析：正常足月新生儿出生时身长约50cm，前半年平均每月增长2.5cm，后半年平均每月增长1.5cm，第1年身长约增长25cm，第2年约增长10cm～12cm。掌握“体格生长常用指标”知识点。